下列有关肾移植受者临床表现说法错误的是
A. 多尿
B. 尿素氮升高
C. 补体水平下降
D. 血小板减少
E. 移植区胀痛

正确答案：A。多尿

解析：肾移植受者临床表现为移植区胀痛、少尿或无尿，尿素氮升高、补体水平下降、血小板减少。及早给予适当的免疫抑制剂可延缓排斥。掌握“移植免疫”知识点。